女性，35岁。持续性血压升高2个月，疑诊嗜铬细胞瘤，则下列检查中哪项检查的敏感性和特异性最高
A. 尿香草基杏仁酸
B. 尿甲氧基肾上腺素和甲氧基去甲肾上腺素
C. 尿皮质醇
D. 尿17-酮
E. 尿17-羟

正确答案：B。尿甲氧基肾上腺素和甲氧基去甲肾上腺素

解析：嗜铬细胞瘤可持续地释放大量儿茶酚胺，引起持续性高血压，持续性高血压患者儿茶酚胺及其代谢物香草基杏仁酸及甲氧基肾上腺素（MN）和甲氧基去甲肾上腺素（NMN）皆升高，常在正常值两倍以上，其中以甲氧基肾上腺素（MN）和甲氧基去甲肾上腺素（NMN）的敏感性和特异性最高（B对A错）。尿皮质醇（C错）、尿17-酮皮质类固醇（D错）、尿17-羟皮质类固醇（E错）均用于库欣综合征的诊断（P700），对于嗜铬细胞瘤诊断意义不大。